兼有镇静，催眠，抗惊厥，抗癫痫作用的药物是
A. 苯妥英钠
B. 地西泮
C. 水合氯醛
D. 扑米酮
E. 司可巴比妥

正确答案：B。地西泮

解析：地西泮为苯二氮（艹卓）类药物，具有抗焦虑药，具有抗焦虑、镇静、催眠、抗惊厥、抗癫痫及中枢性肌肉松弛作用。掌握“苯二氮?类”知识点。